先天愚型
A. 遗传性疾病
B. 遗传易感性疾病
C. 社会性疾病
D. 心理性疾病
E. 免疫性疾病

正确答案：A。遗传性疾病

解析：遗传性疾病（A对）指染色体畸变和基因变异引起的疾病。染色体畸变包括数目畸变和结构畸变两类，其中常染色体畸变通常可导致先天性智力低下，生长发育迟缓，即先天愚型。